杆形卡环与圆环形卡环相比较主要不足之处是
A. 固位作用差
B. 稳定作用差
C. 支持作用差
D. 弹性作用差
E. 对基牙损伤大

正确答案：B。稳定作用差

解析：本题考查杆形卡环的缺点。杆形卡环与圆环形卡环相比较主要不足之处是稳定作用差（B对）。杆形卡环可根据基牙的外形、倒凹位置和大小，设计成不同的形状和种类，其主要优点是：金属外露少，美观；基牙外形磨改量少，对基牙损伤小（E错）推型固位作用强（A错）；降低游离端义齿加到末端基牙上的扭力。其主要缺点是：口腔前庭浅、软组织倒凹大、系带附着高等情况下不宜使用；与圆环形卡环相比较，其卡抱和稳定作用差，可能由于杆形卡环与基牙的接触面积较小所致，但支持作用（C错）、弹性作用 （D错）尚可。